患者，男，45岁。胃脘无节律性胀痛半年，胃脘胀满，时而伴两胁不适，呕吐吞酸，食少纳差，舌淡红苔薄白，脉弦。X线钡餐检查：胃小弯部有充盈缺损。其证型是
A. 气血亏虚
B. 肝胃不和
C. 脾胃虚寒
D. 痰食交阻
E. 痰瘀内结

正确答案：B。肝胃不和

解析：患者胃脘无节律性胀痛半年，病为胃痛。肝主疏泄而喜条达，若情志不舒，则肝气郁结不得疏泄，横逆泛胃而胃脘胀满，时而伴两胁不适，呕吐吞酸，食少纳差；病在气分而湿浊不甚，故见舌淡红苔薄白；病在里而属肝主痛，故见脉弦。X线钡餐检查：胃小弯部有充盈缺损。可诊断为慢性胃炎肝胃不和证（B对），治法为疏肝理气，和胃止痛，方药选用柴胡疏肝散加减。气血亏虚（A错）特点为胃脘隐隐作痛，神疲乏力，面色苍白。脾胃虚寒（C错）特点为胃脘隐痛，喜温喜按，食后胀满痞闷，纳呆、便溏，神疲乏力。痰食交阻（D错）特点为脘腹胀满、拒按，恶食，嗳腐吞酸。痰瘀内结（E错）表现为胃脘疼痛如针刺，痛有定处，入夜尤甚，身体困重，纳呆。